降压药联用硝酸酯类药物引起直立性低血压是
A. 增强作用
B. 增敏作用
C. 脱敏作用
D. 诱导作用
E. 拮抗作用

正确答案：A。增强作用

解析：本题考查药物的相互作用。硝酸酯类与降压药联用会增加降压作用，引起直立性低血压，属于药物协同作用中的增强作用（A对）；增敏作用（B错）指某药可使组织或受体对另一药的敏感性增强；脱敏作用（C错）指某药可使组织或受体对另一药物的敏感性减弱；酶诱导效应（D错）指某些药能增加肝药酶的活性，使药物代谢加快；拮抗作用（E错）指两种或两种以上药物作用相反，或发生竞争性或生理性拮抗作用。